居住建筑密度是指
A. 每人居住建筑用地面积
B. 单位面积上的居住人数
C. 使用面积占建筑面积之比
D. 居住建筑基底面积/居住建筑用地面积
E. 每万平方米上的建筑物个数

正确答案：D。居住建筑基底面积/居住建筑用地面积

解析：本题考查居住建筑密度。居住建筑密度是指居住建筑基底面积/居住建筑用地面积（D对ABCE错）。居住建筑密度过高则院落空地相对减少，影响绿化和居民室外休息场地，房屋的间距、日照通风也将不能保证。